治疗脱疽湿热毒盛证，应首选的方剂是
A. 阳和汤
B. 四妙勇安汤
C. 桃红四物汤
D. 顾步汤
E. 黄芪鳖甲汤

正确答案：B。四妙勇安汤

解析：阳和汤组成熟地、肉桂、白芥子、姜炭、生甘草、麻黄、鹿角胶，功能温阳补血，散寒通滞，治疗寒湿阻络证（A错）。四妙勇安汤组成为银花、玄参、当归、甘草，可活血清热解毒，加上连翘、黄柏等药，可治疗湿热毒盛证（B对）。桃红四物汤组成为红花、桃仁、地黄、芍药、当归、川芎，可活血养血，治疗血脉瘀阻证（C错）。顾步汤组成牛膝、金钗石斛、人参、黄芪、当归、金银花，可清热解毒，养阴活血，治疗热毒伤阴证（D错）。黄芪鳖甲汤组成人参、肉桂、苦梗、生地黄、半夏、紫苑、知母、赤芍、黄芪、炙甘草、桑白皮、天门冬、鳖甲、秦艽、茯苓、地骨皮、柴胡，可益气养阴，治疗气阴两虚证（E错）。